下列给药途径中，产生效应最快的是
A. 口服给药
B. 经皮给药
C. 吸入给药
D. 肌内注射
E. 皮下注射

正确答案：C。吸入给药

解析：本题考查吸入给药。吸入给药（C对）产生的效应最快，吸入肺部，肺泡表面积大、能够迅速吸收，直接进入血液循环，无首关效应。